含碳酸氢钠或有机酸的制剂类型是
A. 泡腾颗粒
B. 可溶颗粒
C. 混悬颗粒
D. 缓释颗粒
E. 肠溶颗粒

正确答案：A。泡腾颗粒

解析：本题考查颗粒剂。含有碳酸氢钠和有机酸，遇水可放出大量气体的制剂为泡腾颗粒（A对）；可溶颗粒（B错）是普通颗粒剂；混悬颗粒（C错）是指难溶性固体药物与适宜辅料制成一定粒度的干燥颗粒剂；缓释颗粒（D错）是指在规定的释放介质中缓慢的非恒速的释放药物的颗粒剂；肠溶颗粒（E错）是指在胃内不分解，在肠中代谢吸收的制剂。